吸烟是导致肺癌的
A. 充分病因
B. 必要病因
C. 两者均是
D. 两者均否

正确答案：D。两者均否

解析：本题考查充分病因和必要病因。吸烟既不是导致肺癌的充分病因也不是必要病因（D对ABC错）。吸烟可以引起肺癌，但是绝大多数吸烟者一生也不会患上肺癌。